某女，53岁。患肾虚作喘与尿频泄泻，宜选用的药物是
A. 补骨脂
B. 淫羊藿
C. 绞股蓝
D. 肉苁蓉
E. 益智仁

正确答案：A。补骨脂

解析：本题考查的是补骨脂的主治病证。患肾虚作喘与尿频泄泻，宜选用的药物是补骨脂（A对）。补骨脂：【主治病证】（1）肾阳不足之阳痿、腰膝冷痛。（2）肾虚不固之滑精、遗尿、尿频。（3）脾肾阳虚之泄泻。（4）肾虚作喘。此外，还可外治白癜风。淫羊藿（B错）：【主治病证】（1）肾虚之阳痿、不孕、尿频、筋骨痿软。（2）风寒湿痹或肢体麻木。绞股蓝（C错）：【主治病证】（1）气虚乏力，气津两虚。（2）痰热咳喘，燥痰劳嗽。（3）热毒疮痈，癌肿。肉苁蓉（D错）：【主治病证】（1）肾虚之阳痿、不孕。（2）精血亏虚之腰膝痿弱、筋骨无力。（3）肠燥便秘。益智仁（E错）：【主治病证】（1）肾气虚寒之遗精滑精、遗尿、夜尿频多。（2）脾寒泄泻，腹中冷痛，脾虚口多涎唾。